某女，25岁。月经延迟，小腹胀痛拒按经血量少，血色紫暗有块，经行不畅，经前胸胁、乳房胀痛，饮食可，二便调，舌暗，苔白，脉弦。四诊合参，本病例的中医辨证是
A. 气滞血瘀
B. 阳虚内寒
C. 瘀血阻络
D. 寒滞肝脉
E. 寒凝气滞

正确答案：A。气滞血瘀

解析：本题考查的是痛经的辨证论治。月经延迟，小腹胀痛拒按经血量少，血色紫暗有块，经行不畅，经前胸胁、乳房胀痛，饮食可，二便调，舌暗，苔白，脉弦。四诊合参，本病例的中医辨证是气滞血瘀（A对）。痛经是指女性正值经期或经行前后因胞宫气血变化，致病因素乘时而作所致的疾病，以周期性小腹疼痛，或痛引腰骶，甚则剧痛昏厥者为临床特征。西医学的原发性痛经和继发性痛经表现为上述症状者，可参考此内容辨证论治。（一）气滞血瘀证：【症状】经前或经期小腹胀痛，经血量少，行而不畅，经色紫暗有块，块下则痛减；乳房胀痛，胸闷不舒。舌质紫暗或有瘀点，脉弦。（二）寒凝血瘀证：【症状】经行小腹冷痛，得热则舒，经量少，色紫暗有块；形寒肢冷小便清长。脉细或沉紧。（三）湿热瘀阻证：【症状】经前或经期小腹灼热胀痛，拒按，经色暗红，质稠有块；平素带下量多色黄，或平时小腹疼痛，经来疼痛加剧，或伴经前低热，小便黄赤。舌紫红，苔黄而腻，脉滑数或涩。（四）气血虚弱证：【症状】经期或经后小腹隐痛喜按，或小腹空坠不适，月经量少，色淡，质清稀；面色无华，头晕心悸，神疲乏力。舌淡，脉细无力。（五）肝肾亏虚证：【症状】经期或经后小腹绵绵作痛，经行量少，色暗淡，质稀薄；腰膝酸软，头晕耳鸣；舌淡红，苔薄，脉沉细。阳虚（B错）：又称“阳偏衰”，是指机体阳气虚损、功能减退或衰弱、热量不足的病机变化。阳虚则寒，不但可见到面色白、畏寒肢冷、舌淡、脉迟等寒象，而且还有喜静踡卧、小便清长、下利清谷等虚象。瘀血阻络（C错）为崩漏的辨证。崩漏瘀血阻络证：【症状】经血非时而下，量时多时少，时出时止，或淋沥不断，或停闭数月又突然崩中，继之漏下，经色暗有血块；舌质紫暗或尖边有瘀点，脉弦细或涩。寒滞肝脉（D错）的临床表现，常见少腹胀痛，牵引睾丸，或睾丸胀大下坠，或阴囊冷缩，舌润苔白，脉多沉弦。寒凝气滞（E错）可引起胸痹、胃脘胀痛、月经后期等。